女，72岁。摔伤右髋部，既往全身情况良好。查体：右下肢缩短，外旋畸形，下肢轴向叩击痛阳性。最可能的诊断是
A. 髋关节后脱位
B. 股骨干骨折
C. 髋部软组织损伤
D. 股骨颈骨折
E. 髋关节前脱位

正确答案：D。股骨颈骨折

解析：老年女性患者，有摔伤史，右下肢缩短、外旋畸形（提示可能为股骨颈骨折），下肢轴向叩击痛阳性，结合患者病史、临床表现及体查结果，该患者最可能的诊断为右侧股骨颈骨折（D对）。髋关节后脱位（A错）患者有明显的外伤史，患肢短缩，髋关节呈屈曲、内收、内旋畸形。股骨干骨折（B错）患者可出现骨折特有表现，如短缩、畸形、出现异常活动，受伤部位大多在髋以下、膝以上。髋部软组织损伤（C错）患者不会出现下肢短缩，外旋畸形。髋关节前脱位（E错）患者多有强大暴力所致外伤史，患肢呈外展、外旋和屈曲畸形。